妊娠期龈瘤妨碍进食，如必需手术，可选择
A. 妊娠4～6个月时手术切除
B. 妊娠3～8个月时手术切除
C. 只做菌斑控制，不切除
D. 随妊娠月份增加会自行消退
E. 以上都是

正确答案：A。妊娠4～6个月时手术切除

解析：本题考查妊娠期龈瘤的手术时间。妊娠期龈瘤妨碍进食，如必需手术，可选择妊娠4～6个月时手术切除（A对），选择在妊娠期1～3个月手术可能会引起流产，选择在妊娠期7～10个月手术可能会引起早产，所以不能选择妊娠3～8个月时手术切除（B错）。只做菌斑控制，牙龈的炎症和肥大能明显消退或消失，但一些体积较大的妊娠期龈瘤不能完全消退，不切除会妨碍进食（C错） 。患者一般在妊娠前即有不同程度的慢性龈炎，从妊娠2～3个月后开始出现明显症状，至8个月时达到高峰，分娩后约个2月时，龈炎可减轻至妊娠前水平（D错）。随着妊娠月份增加妊娠期龈瘤先逐渐增大至8个月达高峰期，以后逐渐缩小，呈现先增大后缩小的增长变化趋势，而不是随妊娠月份增加会自行消退（D错）。